药品生产企业作出二级召回决定后，应当在规定时间内通知有关药品经营企业使用单位停止销售和使用。其中的“规定时间”是
A. 7日内
B. 48小时内
C. 72小时内
D. 24小时内

正确答案：B。48小时内

解析：本题考查的是生产企业药品召回的时间规定。药品生产企业作出二级召回决定后，应当在规定时间内通知有关药品经营企业使用单位停止销售和使用。其中的“规定时间”是48小时内（B对）。生产企业药品召回的时间规定：药品生产企业在作出药品召回决定后，应当制定召回计划并组织实施：一级召回在24小时内（D错），二级召回在48小时内，三级召回在72小时内（C错），通知到有关药品经营企业、使用单位停止销售和使用，同时向所在地省级药品监督管理部门报告。药品生产企业在启动药品召回后，一级召回在1日内，二级召回在3日内，三级召回在7日内，应当将调查评估报告和召回计划提交给所在地省级药品监督管理部门备案。省级药品监督管理部门应当将收到一级药品召回的调查评估报告和召回计划报告国家药品监督管理部门。药品生产企业在实施召回的过程中，一级召回每日，二级召回每3日，三级召回每7日，向所在地省级药品监督管理部门报告药品召回进展情况。